关于人类胚胎干细胞研究和应用的伦理原则，错误的是
A. 无论胚胎是不是人，都应该得到尊重
B. 需先经动物实验等措施.以符合安全和有效的原则
C. 禁止故意生产、销售、买卖配子和胚胎等，以防止商品化
D. 配子和胚胎等属于个人财产，允许买卖，符合公平的原则
E. 与病人或受试者有关的信息应充分告知

正确答案：D。配子和胚胎等属于个人财产，允许买卖，符合公平的原则